动脉血管出血时呈现
A. 漫出状，血色暗红
B. 漫出状，血色鲜红
C. 喷射状，血色暗红
D. 喷射状，血色鲜红
E. 以上均不是

正确答案：D。喷射状，血色鲜红

解析：止血时首先判断是什么血管损伤，一般动脉血成喷射状，血色鲜红，静脉血呈漫出状，血色暗红。掌握“口腔颌面部创伤急救”知识点。